温度刺激出现迟缓且不严重的疼痛，表明
A. 牙髓正常
B. 牙髓坏死
C. 可复性牙髓炎
D. 急性牙髓炎
E. 慢性牙髓炎

正确答案：E。慢性牙髓炎

解析：本题考查牙髓温度测验。慢性牙髓炎温度刺激出现迟缓且不严重的疼痛（E对）。牙髓正常表现为被测牙与正常对照牙的反应程度相同（A错）。牙髓坏死表现为被测牙对温度刺激不产生反应（B错）。可复性牙髓炎表现为一过性疼痛反应，去除刺激后疼痛立即消失（C错）。急性牙髓炎表现为温度刺激引发剧烈疼痛，刺激去除后疼痛仍持续一段时间（D错）。